女，23岁。妊娠26周，腹胀2天入院。体格检查：血压130/90mmHg，痛苦表情，发绀，不能平卧。产科检查：宫高36cm，腹围102cm，胎位不清，胎心未听到。最可能的诊断是
A. 妊娠合并心脏病
B. 妊娠高血压综合征
C. 死胎
D. 羊水过多
E. 双胎妊娠

正确答案：D。羊水过多

解析：青年孕妇，妊娠26周，腹胀2天入院，痛苦表情，发绀，不能平卧（急性羊水过多的患者因横膈抬高，出现呼吸困难，甚至发绀，不能平卧）。产科检查：宫高36cm（妊娠26周的正常宫高是21.5～26.5CM），腹围102cm（妊娠26周的正常腹围约87cm），胎位不清，胎心未听到（急性羊水过多患者子宫明显大于妊娠月份，胎位不清，胎心遥远或听不清），该患者可诊断为羊水过多（D对）。妊娠合并心脏病（P85）（A错）可出现心悸、气短、心动过速等。妊娠期高血压疾病（P67）（B错）主要表现为高血压、蛋白尿和水肿。死胎（P120）（C错）的临床表现是孕妇自觉胎动停止，子宫停止增长。双胎妊娠（P122）（E错）在妊娠6周产前检查时可发现，26周可闻及胎心音。